依据WHO提出的癌症三级止痛阶梯治疗方案正确的是
A. 最初用吗啡类药
B. 以注射给药为主
C. 效果不明显时，换用非吗啡类药
D. 从小剂量开始，视止痛效果渐增量
E. 根据疼痛发作与否非定期给药

正确答案：D。从小剂量开始，视止痛效果渐增量

解析：在控制癌性疼痛时，应严格遵守癌痛三阶梯治疗的基本原则，以提高镇痛效果、避免患者对药物产生依赖性及减少患者对药物敏感性下降的发生。根据癌症三阶梯疗法的治疗方案（P70），应根据疼痛的程度选择镇痛药，从小剂量开始，视止痛效果逐渐增量（D对）；加量用药无效时，应按照非阿片类、弱阿片类、强阿片类的顺序逐级使用镇痛药。吗啡为强阿片类镇痛药，应在第三阶段使用，而非最初用吗啡类药（A错）。因阿片类要为最强的镇痛药，若使用阿片类效药物镇痛效果不明显，应增加药物用量，而不是换用非吗啡类药物（C错）。根据癌痛的三阶梯疗法基本原则，镇痛给药时，以口服给药为主，只有当患者口服药物困难时可采用注射给药（B错）。患者在镇痛治疗过程中，应根据药理特性有规律的按时用药，而不是根据疼痛发作与否进行非定期的给药（E错）。